违反《中华人民共和国广告法》的规定，在药品广告发布中说明治愈率或有效率的，对广告者责令改正、没收广告费用，可并处罚款，实施处罚的机关是
A. 药品监督管理部门
B. 物价管理部门
C. 市场监督管理部门
D. 卫生行政管理部门
E. 公安部门

正确答案：C。市场监督管理部门

解析：本题考查违反药品广告管理的处罚。违反《中华人民共和国广告法》的规定，在药品广告发布中说明治愈率或有效率的，对广告者责令改正、没收广告费用，可并处罚款，实施处罚的机关是市场监督管理部门（C对）。违反药品广告管理的处罚：（一）未显著、清晰表示应当显著标明内容的广告：未显著、清晰表示广告中应当显著标明内容的，按照《广告法》第五十九条处罚，由市场监督管理部门责令停止发布广告，对广告主处十万元以下的罚款。（二）无有效批准文件发布的广告：未经审查发布药品、医疗器械、保健食品和特殊医学用途配方食品广告；或者广告批准文号已超过有效期，仍继续发布药品广告；以及未按照审查通过的内容发布药品广告，按照《广告法》第五十八条处罚，由市场监督管理部门责令停止发布广告，责令广告主在相应范围内消除影响，处广告费用一倍以上三倍以下的罚款，广告费用无法计算或者明显偏低的，处十万元以上二十万元以下的罚款；情节严重的，处广告费用三倍以上五倍以下的罚款，广告费用无法计算或者明显偏低的，处二十万元以上一百万元以下的罚款，可以吊销营业执照，并由广告审查机关撤销广告审查批准文件、一年内不受理其广告审查申请。（三）进行虚假宣传：进行虚假宣传的，依照《广告法》第五十八条的规定处罚，由市场监督管理部门责令停止发布广告，责令广告主在相应范围内消除影响，处广告费用一倍以上三倍以下的罚款，广告费用无法计算或者明显偏低的，处十万元以上二十万元以下的罚款；情节严重的，处广告费用三倍以上五倍以下的罚款，广告费用无法计算或者明显偏低的，处二十万元以上一百万元以下的罚款，可以吊销营业执照，并由广告审查机关撤销广告审查批准文件、一年内不受理其广告审查申请。构成虚假广告的，依照《广告法》第五十五条的规定处罚，由市场监督管理部门责令停止发布广告，责令广告主在相应范围内消除影响，处广告费用三倍以上五倍以下的罚款，广告费用无法计算或者明显偏低的，处二十万元以上一百万元以下的罚款；两年内有三次以上违法行为或者有其他严重情节的，处广告费用五倍以上十倍以下的罚款，广告费用无法计算或者明显偏低的，处一百万元以上二百万元以下的罚款，可以吊销营业执照，并由广告审查机关撤销广告审查批准文件、一年内不受理其广告审查申请。对于其他发布虚假药品广告的情形，《广告法》及其他法律法规有规定的，依照相关规定处罚，没有规定的，由县级以上市场监督管理部门责令改正；对负有责任的广告主、广告经营者、广告发布者处以违法所得三倍以下罚款，但最高不超过三万元；没有违法所得的，可处一万元以下罚款。（四）不得宣传发布的药品广告：使用或者变相使用国家机关、国家机关工作人员、军队单位、军队人员的名义和形象，利用军队装备、设施等从事广告宣传，或者对不得发布广告而进行广告宣传，以及未在指定刊物是发布处方药广告的，按照《广告法》第五十七条处罚，由市场监督管理部门责令停止发布广告，对广告主处二十万元以上一百万元以下的罚款，情节严重的，并可以吊销营业执照，由广告审查机关撤销广告审查批准文件、一年内不受理其广告审查申请；对广告经营者、广告发布者，由市场监督管理部门没收广告费用，处二十万元以上一百万元以下的罚款，情节严重的，并可以吊销营业执照、吊销广告发布登记证件。（五）以不当方式获得批准文件：隐瞒真实情况或者提供虚假材料申请药品、医疗器械、保健食品和特殊医学用途配方食品广告审查的；或者以欺骗、贿赂等不正当手段取得药品、医疗器械、保健食品和特殊医学用途配方食品广告批准文号的，按照《广告法》第六十五条处罚，广告审查机关不予受理或者不予批准，予以警告，一年内不受理该申请人的广告审查申请；以欺骗、贿赂等不正当手段取得广告审查批准的，广告审查机关予以撤销，处十万元以上二十万元以下的罚款，三年内不受理该申请人的广告审查申请。